男，27岁，牙龈疼痛，自动出血3天。检查：腐败性口臭，多个牙的牙龈乳头尖端消失变平，下切牙的龈缘虫蚀状坏死，有灰白膜覆盖。该病的最可能诊断是急性坏死性龈炎，导致该病的主要病原微生物为
A. 伴放线放线杆菌
B. 牙龈卟啉单胞菌
C. 葡萄球菌
D. 梭形杆菌和螺旋体
E. 放线菌

正确答案：D。梭形杆菌和螺旋体

解析：本题考查急性坏死性溃疡性龈炎的主要病原微生物。急性坏死性龈炎是一种由多种微生物引起的机会性感染，主要由梭形杆菌和螺旋体引起（D对）。在病变区的细菌学涂片检查可见大量梭形杆菌和螺旋体与坏死组织及其他细菌混杂。伴放线放线杆菌（A错）是侵袭性牙周炎的主要致病菌。牙龈卟啉单胞菌（B错）是慢性牙周炎的主要致病菌。葡萄球菌（C错）是最常见的化脓性球菌，不是急性坏死性龈炎的主要致病菌，是化脓性感染的致病菌。放线菌（E错）是口腔正常菌群成员，主要定植在牙菌斑、牙石、龈沟、口腔黏膜和唾液等部位，在龈下菌群和人类根面龋中最常分离到放线菌，它不是急性坏死性龈炎的主要致病菌。